患者，女，24岁。产后4周恶露不止，量多，色淡红，质稀，小腹空坠，神疲体倦，舌淡苔薄白，脉缓弱。其证候是
A. 虚
B. 肾虚
C. 虚寒
D. 气虚
E. 脾虚

正确答案：D。气虚

解析：患者产后4周恶露不止，量多，色淡红，质稀，是因为气虚冲任子宫失摄，恶露过期不止而量多；小腹空坠，神疲体倦，舌淡苔白，脉细弱均为气虚之征（D对）。血虚证以面、睑、唇、舌色淡白，心悸，脉微为主要表现（A错）。肾虚证又分肾阳虚证，常见腰膝酸冷，性欲减退，夜尿多；肾气虚证常见腰膝酸软，小便、精液、经带、胎气不固；肾阴虚常见腰酸而痛，遗精、经少、头晕耳鸣之象（B错）。虚寒证又称阳虚，以畏寒肢冷、小便清长、面白、舌淡为主要表现（C错）。脾虚证又分为脾气虚证、脾虚气陷证、脾阳虚证，脾气虚证多见食少，腹胀，便溏与气虚症状共见为辩证的主要依据；脾虚气陷证多见脘腹重坠，内脏下垂与气虚症状共见为辩证的主要依据；脾阳虚证多见食少，腹胀腹痛，便溏与虚寒症状共见为辩证的主要依据（E错）。